发生腹部绞痛的原因是
A. 腹内脏器破裂
B. 腹膜炎症病变
C. 空腔脏器梗阻
D. 腹腔内出血
E. 腹壁创伤

正确答案：C。空腔脏器梗阻

解析：空腔脏器梗阻（C对）引起的腹痛常为绞痛，如肠梗阻时，于梗阻部位以上的肠管强烈蠕动，即发生腹部绞痛。腹内脏器破裂（A错）如肝脾破裂、异位妊娠破裂等，多呈持续性疼痛，有时也呈绞痛，但是没有空腔脏器梗阻常见。腹膜炎症病变（B错）常由胃肠穿孔引起，疼痛一般位于炎症所在部位，腹痛常因加压、改变体位而加剧，呈持续性锐痛。腹腔内出血（D错）常见于脾破裂，疼痛很快弥漫全腹，呈持续性疼痛。腹壁创伤（E错）疼痛常位于创伤的部位，呈持续性疼痛。